患者，女，35岁。既往有慢性肾炎。全身浮肿，面白，腰膝冷痛，畏寒，纳少乏力，便溏，月经不调，舌胖齿痕，脉沉细。其证型是
A. 脾肾阳虚
B. 肝肾阴虚
C. 脾肾气虚
D. 水湿浸渍
E. 肾阳衰微

正确答案：A。脾肾阳虚

解析：患者既往有慢性肾炎；中阳不振，健运失司，气不化水，以致下焦水邪泛滥，故见全身浮肿；脾虚，阳不温煦故见面白；腰为肾之府，肾阳虚故见腰膝冷痛，畏寒；脾虚运化无力，故见纳少乏力，便溏；舌胖齿痕，脉沉细均为脾肾阳虚证的表现，治法为温补脾肾，方药选用附子理中丸或济生肾气丸加减（A对）。慢性肾小球肾炎肝肾阴虚证（B错）的特点为目睛干涩，或视物模糊，头晕耳鸣，五心烦热或手足心热，口干咽燥，腰肌酸痛，遗精，或月经失调，舌红少苔，脉弦细或细数。慢性肾小球肾炎脾肾气虚证（C错）的特点为腰脊酸痛，神疲乏力，或浮肿，纳呆或脘胀，大便溏薄，尿频或夜尿多，舌质淡，舌有齿痕，苔薄白，脉细。慢性肾小球肾炎水湿浸渍证（D错）的特点为颜面或肢体浮肿，舌苔白或白腻，脉缓或沉缓。肾病综合征肾阳衰微证（E错）的特点为面浮身肿，按之凹陷不起，心悸，气促，腰部冷痛酸重，小便量少或增多，形寒神疲，面色灰滞，舌质淡胖，苔白，脉沉细或沉迟无力。